通常颌面部随意皮瓣的长宽比例为
A. 1：1
B. 1.5：1
C. 2～3：1
D. 4～5：1
E. 6：1

正确答案：C。2～3：1

解析：本题考查皮瓣移植。皮瓣移植也称皮瓣转移。皮瓣是由皮肤的全厚层及皮下组织构成。与游离皮片移植不同的是，皮片必须有与机体皮肤相连的蒂或行血管吻合，血液循环重建后供给皮瓣的血供和营养，才能保证移植皮瓣的存活。随意皮瓣亦称皮肤皮瓣，其特点是由于没有知名血管供血，故在设计皮瓣时，其长宽比例要受到一定限制。在肢体及躯干部位、面部富长宽之比不同。在肢体与躯干部，长宽之比1.5：1为最安全，最好不超过2：1；在面部，由于血液循环丰富，根据实际情况可放宽到2～3：1（C对），在血供特别丰富的部位可达4：1。